情节严重，可处以吊销《医疗机构执业许可证》的违反处方管理和调剂要求的情形是
A. 药师未按照规定调剂处方药品
B. 医疗机构未按照规定保管麻醉药品和精神药品处方
C. 未取得麻醉药品和第一类精神药品处方资格的执业医师擅自开具此类药品处方
D. 医疗机构使用未取得药学专业技术职务任职资格的人员从事处方调剂工作

正确答案：D。医疗机构使用未取得药学专业技术职务任职资格的人员从事处方调剂工作

解析：本题考查处方管理办法。医疗机构使用未取得药学专业技术职务任职资格的人员从事处方调剂工作情节严重，可处以吊销《医疗机构执业许可证》的违反处方管理和调剂要求的情形是医疗机构使用未取得药学专业技术职务任职资格的人员从事处方调剂工作（D对）。处方管理办法第七章法律责任：第五十四条：医疗机构有下列情形之一的，由县级以上卫生行政部门按照《医疗机构管理条例》第四十八条的规定，责令限期改正，并可处以5000元以下的罚款；情节严重的，吊销其《医疗机构执业许可证》：（一）使用未取得处方权的人员、被取消处方权的医师开具处方的；（二）使用未取得麻醉药品和第一类精神药品处方资格的医师开具麻醉药品和第一类精神药品处方的（C错）；（三）使用未取得药学专业技术职务任职资格的人员从事处方调剂工作的。第五十五条：医疗机构未按照规定保管麻醉药品和精神药品处方（B错），或者未依照规定进行专册登记的，按照《麻醉药品和精神药品管理条例》第七十二条的规定，由设区的市级卫生行政部门责令限期改正，给予警告；逾期不改正的，处5000元以上1万元以下的罚款；情节严重的，吊销其印鉴卡；对直接负责的主管人员和其他直接责任人员，依法给予降级、撤职、开除的处分。第五十六条：医师和药师出现下列情形之一的，由县级以上卫生行政部门按照《麻醉药品和精神药品管理条例》第七十三条的规定予以处罚：（一）未取得麻醉药品和第一类精神药品处方资格的医师擅自开具麻醉药品和第一类精神药品处方的；（二）具有麻醉药品和第一类精神药品处方医师未按照规定开具麻醉药品和第一类精神药品处方，或者未按照卫生部制定的麻醉药品和精神药品临床应用指导原则使用麻醉药品和第一类精神药品的；（三）药师未按照规定调剂麻醉药品、精神药品处方的。第五十七条：医师出现下列情形之一的，按照《执业医师法》第三十七条的规定，由县级以上卫生行政部门给予警告或者责令暂停六个月以上一年以下执业活动；情节严重的，吊销其执业证书：（一）未取得处方权或者被取消处方权后开具药品处方的；（二）未按照本办法规定开具药品处方的（A错）；（三）违反本办法其他规定的。第五十八条：药师未按照规定调剂处方药品，情节严重的，由县级以上卫生行政部门责令改正、通报批评，给予警告；并由所在医疗机构或者其上级单位给予纪律处分。第五十九条：县级以上地方卫生行政部门未按照本办法规定履行监管职责的，由上级卫生行政部门责令改正。